甲类传染病指的是
A. SARS、狂犬病
B. 黑热病、炭疽
C. 高致病禽流感、天花
D. 鼠疫、霍乱
E. 伤寒、流行性出血热

正确答案：D。鼠疫、霍乱

解析：甲类传染病包括：鼠疫和霍乱（D对）。SARS、狂犬病（A错）均为乙类传染病。黑热病为丙类传染病、炭疽为乙类传染病（B错）。高致病禽流感为乙类传染病、天花为人类唯一消灭的传染病（C错）。伤寒、流行性出血热（E错）均为乙类传染病。传染病分类总结：（1）甲类传染病包括：鼠疫、霍乱。（2）乙类传染病包括：传染性非典型肺炎、狂犬病、艾滋病、病毒性肝炎、脊髓灰质炎、人感染高致病性禽流感、麻疹、流行性乙型脑炎、登革热、炭疽、细菌性和阿米巴痢疾、肺结核、伤寒和副伤寒、流行性出血热、流行性脑脊膜炎、百日咳、白喉、新生儿破伤风、猩红热、布氏杆菌病、淋病、梅毒、钩端螺旋体病、血吸虫病、疟疾、人感染猪链球菌病、甲型H1N1流感。（3）丙类传染病包括：流行性感冒、流行性腮腺炎、风疹、急性出血性结膜炎、麻风病、流行性和地方性斑疹伤寒、黑热病、棘球蚴病、丝虫病、除霍乱、痢疾、伤寒和副伤寒以外的感染性腹泻病、手足口病。